组织国家药品标准的制定和修订的法定专业技术机构是
A. 药品认证委员会
B. 新药审评中心
C. 药典委员会
D. 药品检验所
E. 药品审评委员会

正确答案：C。药典委员会

解析：本题考查药典委员会。组织国家药品标准的制定和修订的法定专业技术机构是药典委员会（C对）。国家药典委员会是法定的国家药品标准工作专业管理机构，负责组织国家药品标准的制定和修订。国家药典委员会的主要职责为：①组织编制、修订和编译《中华人民共和国药典》（以下简称《中国药典》）及配套标准。②组织制定修订国家药品标准。参与拟订有关药品标准管理制度和工作机制。③组织《中国药典》收载品种的医学和药学遴选工作。负责药品通用名称命名。④组织评估《中国药典》和国家药品标准执行情况。⑤开展药品标准发展战略、管理政策和技术法规研究。承担药品标准信息化建设工作。⑥开展药品标准国际（地区）协调和技术交流，参与国际（地区）间药品标准适用性认证合作工作。⑦组织开展《中国药典》和国家药品标准宣传培训与技术咨询，负责《中国药品标准》等刊物编辑出版工作。⑧负责药典委员会各专业委员会的组织协调及服务保障工作。药品认证委员（A错）承担境内药品生产企业（车间）和药品品种的GMP认证，境外生产的进口药品GMP认证。药品审评中心（B错）是国家食品药品监督管理局药品审评中心，负责对新药、仿制药、补充申请等进行审评。药品检验所（D错）承担药品、保健食品、化妆品、医疗器械等质量检验与技术仲裁检验。药品审评委员会（E错）负责对新药的化学、药理、毒理、临床药理等进行审评鉴定。